用于治疗抑郁症的药物是
A. 氟哌啶醇
B. 丙咪嗪
C. 芬太尼
D. 氯氮平
E. 苯海索

正确答案：B。丙咪嗪

解析：本题考查抗抑郁药。丙咪嗪（B对）为抗抑郁药。氟哌啶醇（A错）是抗精神分裂药。芬太尼（C错）是强效麻醉性镇痛药。氯氮平（D错）是抗精神病药。苯海索（E错）为抗帕金森病药。